经链霉素和异烟肼治疗无效的病人患者常用
A. 乙胺丁醇
B. 利福平
C. 卷曲霉素
D. 紫霉素
E. 吡嗪酰胺

正确答案：A。乙胺丁醇

解析：乙胺丁醇临床应用：用于各型肺结核和肺外结核。与异烟肼和利福平合用治疗初治患者，与利福平和卷曲霉素合用治疗复治患者。特别适用于经链霉素和异烟肼治疗无效的病人。掌握“异烟肼、利福平及乙胺丁醇”知识点。